急性胰腺炎时，血脂肪酶开始升高的时间一般是在发病后
A. 72小时
B. 24小时
C. 48小时
D. 10小时
E. 2小时

正确答案：B。24小时

解析：急性胰腺炎（AP）是多种病因导致胰腺组织自身消化所出现的胰腺炎症性损伤，临床上以急性腹痛加之血淀粉酶及血脂肪酶升高为主要特点。24小时（B对）为血脂肪酶及尿淀粉酶（九版外科学P431）开始升高的时间。2小时（E错）为血淀粉酶在起病后开始升高的时间。